下列哪项不是乳癌的临床表现
A. 肿块生长速度较快
B. 癌块表面皮肤凹陷
C. 肿块表面光滑，活动度良好
D. 橘皮样外观
E. 最早表现为无痛，单发小肿块

正确答案：C。肿块表面光滑，活动度良好